适宜N-亚硝基化合物在体内合成的场所是
A. 肺
B. 胃
C. 血液
D. 肝脏
E. 肾脏

正确答案：B。胃

解析：本题考查N-亚硝基化合物在体内合成的场所。N-亚硝基化合物在pH＜3的酸性环境中利于合成，而且胃中存在亚硝酸盐和具有催化作用的氯离子和硫氰酸根离子，因此适宜N-亚硝基化合物在体内合成的场所是胃（B对ACDE错）。